下列关于龈增生组织病理变化不正确的是
A. 纤维结缔组织增生
B. 粗大的胶原纤维束类似瘢痕组织结构
C. 胶原纤维水肿、变性
D. 毛细血管增生、扩张、充血
E. 炎症明显

正确答案：E。炎症明显

解析：本题考查牙龈疾病。下列关于龈增生组织病理变化不正确的是炎症明显（E错，为本题正确答案）。龈增生其主要组织病理学变化为纤维结缔组织增生，粗大的胶原纤维束类似瘢痕组织结构；还可出现胶原纤维水肿、变性及毛细血管增生、扩张、充血等变化。一般炎症不明显。上述龈增生合并口腔菌斑感染时，则与慢性龈炎并存，其病理学变化也出现炎症反应的一系列改变。